造成子宫收缩的激素
A. 前列腺素E2及前列腺素F2α
B. 血管紧张素
C. 肾素
D. 催乳素
E. 抗利尿激素

正确答案：A。前列腺素E2及前列腺素F2α

解析：前列腺素有收缩子宫的作用，其中以前列腺素E2及前列腺素F2α的活性最强，尤其在分娩中具有重要意义（A对）。前列腺素引起子宫收缩的特性与生理性的阵痛相似，在增强子宫平滑肌节律性收缩作用的同时，尚能使子宫颈松弛。可以用于终止早期或中期妊娠，还可以用于足月或过期妊娠引产，发生良性葡萄胎时可用于排除宫腔内的异物。